为保证刷牙时不遗漏一些部位，每个部位至少刷
A. 2～3次
B. 2～5次
C. 5～10次
D. 10～15次
E. 15次

正确答案：C。5～10次

解析：为保证刷牙时不遗漏某些部位，建议按照一定的顺序刷牙做到面面刷到。每次牙刷放置的位置一般占1～3颗牙面的距离，每个部位至少刷5～10次，然后移至下一个邻牙刷牙位置，两个刷牙位置之间均应有重叠。掌握“自我口腔保健方法”知识点。